后丘脑
A. 位于背侧丘脑的后下方
B. 位于中脑顶盖前区
C. 外侧膝状体接受听觉传导路的纤维
D. 与丘脑前核有密切纤维联系
E. 无

正确答案：A。位于背侧丘脑的后下方

解析：后丘脑居于背侧丘脑的后下方（A对），中脑顶盖的上方（B错），内侧膝状体接受听觉传导路的纤维（C错），后丘脑与丘脑外侧核群有密切纤维联系（D错）。